《互联网药品信息服务管理办法》规定，提供互联网药品信息服务的网站不得发布的产品信息有
A. 血液制品
B. 麻醉药品
C. 戒毒药品
D. 医疗机构制剂
E. 中药材

正确答案：B、C、D。麻醉药品；戒毒药品；医疗机构制剂

解析：本题考查互联网药品信息服务管理。《互联网药品信息服务管理办法》第九条 提供互联网药品信息服务的网站不得发布麻醉药品（B错，为本题正确答案）、精神药品、医疗用毒性药品、放射性药品、戒毒药品（C错，为本题正确答案）和医疗机构制剂（D错，为本题正确答案）的产品信息。